急性牙槽脓肿疼痛表现有下列一些，但不包括
A. 自发性疼痛
B. 放散性疼痛
C. 持续性疼痛
D. 搏动性疼痛
E. 咬合时疼痛

正确答案：B。放散性疼痛

解析：本题考查急性化脓性根尖周炎。急性牙槽脓肿疼痛表现有下列一些，但不包括放散性疼痛（B错，为本题的正确答案）。急性牙髓炎常表现为放散痛。急性牙槽脓肿临床上为3个阶段：根尖周脓肿、骨膜下脓肿以及黏膜下脓肿。在根尖周脓肿阶段患牙表现为自发痛（A对）、剧烈持续性的跳痛（C对），咬合痛（E对）；骨膜下脓肿阶段的患牙表现为持续性、搏动性跳痛（D对）更加剧烈，疼痛达到最高峰。